能用于细菌内毒素检查的方法是
A. 鲎试验法
B. 气泡点法
C. 超滤法
D. 吸附法
E. 反渗透法

正确答案：A。鲎试验法